关于配伍变化的错误表述是
A. 两种以上的药物
B. 配伍禁忌系指可能引起治疗作用减弱甚至消失，或导致毒副作用增强的配伍变化
C. 配伍变化包括物理的、化学的和药理的三方面配伍变化
D. 药理的配伍变化又称为疗效的配伍变化
E. 药物相互作用包括药动学的相互作用和药效学的相互作用

正确答案：A。两种以上的药物

解析：本题考查药物的配伍变化。两种以上药物配伍使用既有协同作用也有拮抗作用，不能避免一切配伍变化（A错，为本题的正确答案）；药理学配伍禁忌可能增加毒性而导致治疗作用减弱甚至消失（B对）；配伍变化包括物理、化学和药理学方面配伍变化（C对）；药物的配伍变化又称为疗效的配伍变化（D对）；药物相互作用包括药动学的相互作用和药效学的相互作用（E对）。